应专柜存放并指定双人双锁保管的是
A. 内服药与外用药
B. 麻醉药品
C. 第二类精神药品
D. 化学药品危险品
E. 长期储存的怕压商品

正确答案：B。麻醉药品

解析：本题考查实行双人双锁。应专柜存放并指定双人双锁保管的是麻醉药品（B对）。麻醉药品和第一类精神药品入出库实行双人核查制度，药品入库须双人验收，出库须双人复核，做到账、物相符。